口腔黏膜色素痣的临床表现相似于黑色素瘤，需根据什么确诊
A. 根据组织病理学特点确诊
B. 根据临床表现确诊
C. 根据X线片确诊
D. 取活检确诊
E. 根据穿刺结果确诊

正确答案：D。取活检确诊

解析：口腔黏膜色素痣的临床表现相似于黑色素瘤，应当取活检确诊。掌握“口腔黏膜色素痣”知识点。